男，38岁。醉酒后出现发热，咳嗽、咳脓臭痰5天，伴右侧胸痛。查体：T39.2℃，P112次/分，R26次/分，BP130/80mmHg。神志清楚，右中肺少许湿性啰音。胸部X线片示右中肺团块状影。可见空洞和气液平。血WBC16.3×10⁹/L，N0.88，L0.10。该患者最可能的诊断是
A. 大叶性肺炎
B. 肺脓肿
C. 肺结核
D. 肺癌
E. 真菌性肺炎

正确答案：B。肺脓肿

解析：中年男性患者，醉酒后出现发热、咳嗽、咳脓臭痰（提示有厌氧菌感染）5天，伴右侧胸痛（吸入性肺脓肿的典型病史和临床表现）。查体：T39.2℃（体温正常值36℃～37.3℃，提示严重感染），P112次/分（正常60～100次/分），R26次/分（正常值12～20次/分，提示呼吸急促），BP130/80mmHg（正常值100～120/60～80mmHg）。神志清楚，右中肺少许湿性啰音。胸部X线片示右中肺团块状影，可见空洞和气液平（肺脓肿典型影像学表现）。结合患者症状、体征及实验室检查，考虑诊断为肺脓肿（B对）。吸入性脓肿，可简单记为醉酒+脓臭痰=吸入性肺脓肿，多为厌氧菌感染，速记：“吸（吸入性肺脓肿）烟（厌氧菌）”。大叶性肺炎（A错）（P45）常急骤起病，以高热、寒战、咳嗽、血痰及胸痛为特征。X线影像呈肺段或肺叶急性炎性改变；常有受凉、淋雨、疲劳、醉酒、病毒感染史，多有上呼吸道感染的前驱症状。肺结核（C错）（P65）患者主要表现为低热、盗汗等结核中毒症状，X线胸片见病变多在肺尖或锁骨上下，密度不均，消散缓慢，可形成空洞或肺内播散。肺癌（D错）（P77）多发于中老年，以刺激性干咳和痰中带血为典型表现，中央型肺癌X线胸片显示支气管阻塞征象；周围型肺癌早期多呈局限性小斑片状阴影。真菌性肺炎（E错）（P54）临床表现无特异性，X线表现无特异性，诊断时必须综合考虑宿主因素、临床特征、微生物学检查和组织病理学资料，病理学诊断仍是肺真菌病的金标准。